药品分别按处方药和非处方药进行管理的依据是
A. 品种、规格
B. 适应症
C. 剂量
D. 给药途径
E. 安全性

正确答案：A、B、C、D。品种、规格；适应症；剂量；给药途径

解析：本题考查药品分类。药品分别按处方药和非处方药进行管理的依据是品种、规格（A对）、适应症（B对）、剂量（C对）及给药途径（D对）。《处方药与非处方药分类管理办法（试行）》第二条：根据药品品种、规格、适应症、剂量及给药途径不同，对药品分别按处方药与非处方药进行管理。处方药必须凭执业医师或执业助理医师处方才可调配、购买和使用；非处方药不需要凭执业医师或执业助理医师处方即可自行判断、购买和使用。国家根据药品的安全性（E错），非处方药又被分为甲、乙两类，就用药安全性而言，乙类非处方药相对于甲类非处方药更安全。